能增加左心室后负荷的临床情况是
A. 二尖瓣反流
B. 高血压
C. 房间隔缺损
D. 主动脉瓣反流
E. 室间隔缺损

正确答案：B。高血压

解析：左心室收缩时，必须克服动脉血压，所以高血压（B对）能增加左心室的后负荷。二尖瓣反流（A错）、房间隔缺损（C错）、主动脉瓣反流（D错）和室间隔缺损（E错）增加左心室前负荷。